调剂处方时必须做到“四查十对”，“四查”是指
A. 查处方、查药品、查剂量、查配伍禁忌
B. 查处方、查药品、查数量、查配伍禁忌
C. 查处方、查药品、查剂型、查药价
D. 查处方、查药品、查配伍禁忌、查用药合理性
E. 查处方、查药品、查药品包装、查药品性状

正确答案：D。查处方、查药品、查配伍禁忌、查用药合理性

解析：本题考查四查四对。药师调剂处方时必须做到“四查四对”：查处方，对科别、姓名、年龄；查药品，对药名、剂型、规格、数量；查配伍禁忌，对药品性状、用法用量；查用药合理性，对临床诊断（D对）。